右下5678左下678缺失，基牙稳固，口底较浅，可选择
A. 腭杆
B. 腭板
C. 舌托
D. 舌面板
E. 树脂基托

正确答案：D。舌面板

解析：前牙松动需用夹板固定者；舌系带附着过高或舌面间隙不能容纳舌杆者；舌侧倒凹过大不宜用舌杆者。掌握“局部义齿连接体”知识点。